卡介苗属于
A. 灭活疫苗
B. 减毒活疫苗
C. 类毒素
D. 免疫血清
E. 免疫球蛋白

正确答案：B。减毒活疫苗